目前，我国筛查7～18岁学龄儿童、青少年超重、肥胖的全国统一标准是
A. 身高标准体重
B. 体重指数
C. 身高体重指数
D. 身高坐高指数
E. Rohrer指数

正确答案：B。体重指数